关于干燥方法适用性的叙述，错误的是
A. 沸腾干燥适用于湿粒性物料的干燥
B. 冷冻干燥适用于生物制品的干燥
C. 微波干燥适用于饮片、丸剂等的干燥
D. 喷雾干燥适用于热敏性液态或固态物料的干燥
E. 减压干燥尤适于中药稠膏的干燥

正确答案：D。喷雾干燥适用于热敏性液态或固态物料的干燥